主要根据分子极性大小分离物质的方法是
A. 膜分离法
B. 聚酰胺色谱法
C. 硅胶柱色谱法
D. 离子交换树脂法
E. 分馏法

正确答案：C。硅胶柱色谱法

解析：本题考查的是硅胶柱色谱法的分离原理。主要根据分子极性大小分离物质的方法是硅胶柱色谱法（C对）。硅胶柱色谱法：硅胶吸附色谱法和氧化铝吸附色谱法可以用于柱色谱吸附分离和薄层色谱分离。无论柱色谱还是薄层色谱分离，硅胶、氧化铝都为分离载体，也叫吸附剂，分离原理都是根据吸附能力大小不同进行分离。膜分离法（A错）：膜分离法是一种用天然或人工合成的膜，以外界能量或化学位差为推动力，对双组分或多组分的溶质和溶剂进行分离、分级、提纯或富集的方法。目前，膜过滤技术主要包括渗透、反渗透、超滤、电渗析和液膜技术等。聚酰胺色谱法（B错）：聚酰胺吸附属于氢键吸附，力量较弱，介于物理吸附与化学吸附之间，也称半化学吸附。聚酰胺对黄酮类、醌类等化合物之间的氢键吸附效果较好，特别适合分离酚类、醌类、黄酮类化合物。离子交换树脂法（D错）：即离子色谱法，是根据物质解离程度不同进行分离。该法系以离子交换树脂作为固定相，以水或含水溶剂作为流动相。当流动相流过交换柱时，溶液中的中性分子及具有与离子交换树脂交换基团不能发生交换的离子将通过柱子从柱底流出，而具有可交换的离子则与树脂上的交换基因进行离子交换并被吸附到柱上，随后改变条件，并用适当溶剂从柱上洗脱下来，即可实现物质分离。分馏法（E错）：分馏法是根据物质的沸点进行分离。通常利用中药中各成分沸点的差别进行分离，一般来说，液体混合物沸点相差在100℃以上时，可用反复蒸馏法达到分离的目的，如沸点相差在25℃以下，则需要采用分馏柱，沸点相差越小，则需要的分馏装置越精细。如挥发油和一些液体生物碱的提取分离常采用分馏法。